中年患者，上颌腭部无痛性溃疡，检查发现溃疡深达骨面，骨组织无破坏，溃疡呈火山口状，周围黏膜充血。下列对于此疾病的叙述正确的是
A. 此疾病病理表现可分为高分化型，低分化型和中分化型
B. 此疾病病理表现可分为腺性（筛状）型、管状型和实性型
C. 此病镜下可观察到黏液细胞、表皮样细胞和中间细胞
D. 病程为6～8周，有自限性
E. 腺体内中性粒细胞和淋巴细胞密集浸润

正确答案：D。病程为6～8周，有自限性

解析：根据检查和临床表现可初步断定为坏死性唾液腺化生，为有自限性的良性唾液腺疾病，镜下可观察到上皮呈假上皮瘤样增生，腺小叶坏死，黏液池形成，腺体内有弥散的中性粒细胞、淋巴细胞及浆细胞浸润。而黏液表皮样癌可分为高分化、低分化和中分化三型，镜下可观察到黏液细胞、表皮样细胞和中间细胞三种，腺样囊性癌可分为筛状型、管状型和实性型。掌握“坏死性唾液腺化生与舍格伦综合征”知识点。